下列不属于伤害干预措施的是
A. 美国一些州规定使用安全带
B. 保险公司以低价安装烟雾报警器来防止火灾
C. 设计汽车时注意急救药品及有关器械贮存器
D. 保险公司减少配额使人们提高安全意识
E. 通过宣传教育普及安全知识

正确答案：D。保险公司减少配额使人们提高安全意识

解析：本题考查伤害干预措施。伤害干预措施可分为主动干预和被动干预，主动干预要求宿主采取措施使干预奏效，它要求人们改变某种行为、并且必须记住在每次暴露于危险行为时要实施安全行为。如美国一些州规定使用安全带（A对），通过宣传教育普及安全知识（E对）为主动干预措施。被动干预不需要宿主的行动，一般通过改善因子、媒介或环境来实现，是自动发生作用的措施。如保险公司以低价安装烟雾报警器来防止火灾（B对），设计汽车时注意急救药品及有关器械贮存器（C对）为被动干预措施。保险公司减少配额使人们提高安全意识（D错，为本题正确答案）不属于伤害干预措施。